槐角丸不具有的功能是
A. 清肠
B. 疏风
C. 散瘀
D. 凉血
E. 止血

正确答案：C。散瘀

解析：本题考查的是槐角丸的功能。槐角丸不具有的功能是散瘀（C错，为本题正确答案）。槐角丸：【功能】清肠（A对）疏风（B对），凉血（D对）止血（E对）。散瘀为的三七片功能。三七片：【功能】散瘀止血，消肿止痛。